急性粒细胞白血病治疗首选
A. 甲氨蝶呤
B. 阿霉素
C. DA方案
D. 环磷酰胺
E. VP方案

正确答案：C。DA方案

解析：急性粒细胞白血病（除急性早幼粒细胞白血病外）治疗首选IA方案（去甲氧柔红霉素+阿糖胞苷）或DA方案（柔红霉素+阿糖胞苷）（C对），而急性早幼粒细胞白血病首选全反式维A酸（ATRA）。甲氨喋呤（P575）（A错）是中枢神经系统白血病预防和治疗的首选药；VP方案（长春新碱+泼尼松）（P575）（E错）是急性淋巴细胞白血病首选的治疗方案；阿霉素（B错）可用于淋巴瘤的联合化疗；环磷酰胺（P575）（D错）可用于急、慢性淋巴细胞白血病的治疗。